MPP与ICP属于
A. 侧向关系
B. 垂直向关系
C. 前后向关系
D. 水平向关系
E. 以上都不是

正确答案：B。垂直向关系

解析：ICP牙尖交错位即正中颌位。MPP下颌姿势位也叫息止颌位。垂直距离为天然牙列呈正中（牙合）时，鼻底至颏底的距离，也就是面部下1／3的距离。其两者颌位都属于垂直关系。掌握“下颌运动的形式、范围及意义”知识点。